乙型肝炎的主要传播途径有
A. 经血传播
B. 性接触传播
C. 母婴传播
D. 日常生活接触传播
E. 以上均是

正确答案：E。以上均是